结肠破裂修补术后5天，病人血钠136.0mmol/L，血钾6.8mmol/L，血pH值7.3，近24小时尿量520毫升，应诊断为
A. 低渗性脱水
B. 等渗性脱水
C. 低钾血症
D. 高钾血症
E. 低钾合并等渗性脱水

正确答案：D。高钾血症

解析：患者血钾6.8mmol/L（正常值为3.5～5.5mmol/L），故应诊断为高钾血症（D对C错）。患者血钠136mmol/L处于正常范围，不能诊断为低渗性脱水（A错）。在结肠破裂修补术后，患者可能因为消化液丢失过多而发生脱水，但本例并未明确指出患者存在恶心、呕吐、少尿（24小时尿量少于400ml者称为少尿）或口渴等脱水症状，故不能诊断为脱水（ABE错）。